哪个不是感觉性神经节
A. 膝神经节
B. 腹腔神经节
C. 蜗神经节
D. 三叉神经节
E. 耳神经节

正确答案：B。腹腔神经节

解析：脑神经节包括膝神经节（A对）、舌咽神经及迷走神经下神经节，脑、脊神经节属于感觉性神经节。腹腔神经节（B错，为本题正确选项）属于内脏运动神经节。